舌绛少苔或无苔是
A. 阴虚火旺
B. 热入营血
C. 气分实热
D. 阳明热盛
E. 瘀血阻滞

正确答案：A。阴虚火旺

解析：舌绛少苔或无苔，或有裂纹，多属久病阴虚火旺（A对），或热病后期阴液耗损。舌绛有苔，多属湿温病热入营血，或脏腑内热炽盛（B错）。气分实热、阳明热盛均属于实热证，红舌主热证，故气分实热、阳明热盛可见红舌（CD错），苔黄或黄厚。瘀血阻滞可见青紫舌，由于气血运行不畅，故舌见青紫（E错）。